以下各型肝炎中，哪种型别肯定不经血液传播
A. 甲型肝炎和乙型肝炎
B. 乙型肝炎
C. 甲型肝炎、戊型肝炎
D. 乙型肝炎、丙型肝炎
E. 乙型肝炎、丙型肝炎和丁型肝炎

正确答案：C。甲型肝炎、戊型肝炎